《中国药典》规定，应进行溶化性检查的颗粒剂是
A. 混悬颗粒
B. 肠溶颗粒
C. 缓释颗粒
D. 泡腾颗粒
E. 控释颗粒

正确答案：D。泡腾颗粒

解析：本题考查的是颗粒剂的质量要求。《中国药典》规定，应进行溶化性检查的颗粒剂是泡腾颗粒（D对）。颗粒剂的质量要求：颗粒剂应干燥，颗粒均匀，色泽一致，无吸潮、软化、结块、潮解等现象。除另有规定外，挥发油应均匀喷入干燥颗粒中，密闭至规定时间或用包合等技术处理后加入。（1）水分：除另有规定外，中药颗粒剂含水分不得过8.0%。（2）粒度：不能通过一号筛与能通过五号筛的总和不得过15%。（3）溶出度：除另有规定外，混悬颗粒剂应进行溶出度检查。（4）释放度：肠溶颗粒（B错）、缓释颗粒（C错）、控释颗粒（E错）应进行释放度检查。（5）溶化性：可溶性颗粒，取供试品10g（中药单剂量包装取1袋）加20倍量热水搅拌5分钟，可溶颗粒应全部溶化，允许有轻微混浊；泡腾颗粒，取供试品3袋，分别置盛有200ml水的烧杯中，水温为15℃～25℃，应迅速产生气体而成泡腾状，5分钟内颗粒均应完全分散或溶解在水中。颗粒剂按上述方法检查，均不得有异物，中药颗粒还不得有焦屑。混悬颗粒（A错）以及已规定检查溶出度或释放度的颗粒剂可不进行溶化性检查。（6）装量差异：单剂量包装的颗粒剂每袋（瓶）装量与平均装量相比较［凡无含量测定的颗粒剂或有标示装量的颗粒剂，每袋（瓶）装量应与标示装量比较］，超出装量差异限度的不得多于2袋，并不得有1袋超出限度1倍。凡规定检查含量均匀度的颗粒剂，不再进行装量差异的检查。（7）装量：多剂量包装颗粒剂的最低装量应符合规定。（8）微生物限度、药物的定性鉴别、含量测定与含量均匀度等均应符合各品种项下的有关要求。凡规定进行杂菌检查的颗粒剂，可不进行微生物限度检查。必要时，对包衣颗粒应检查残留溶剂。